除底蜕膜及包蜕膜外，覆盖在宫腔的蜕膜为
A. 底蜕膜
B. 包蜕膜
C. 真蜕膜
D. 叶状绒毛膜
E. 滑泽绒毛膜

正确答案：C。真蜕膜

解析：受精卵着床后，子宫内膜迅速发生蜕膜变，按蜕膜与受精卵的位置关系，将蜕膜分为3部分：①底蜕膜，指与囊胚极滋养层接触的子宫肌层之间的蜕膜，以后发育成为胎盘的母体部分；②包蜕膜，指覆盖在囊胚上面的蜕膜，约在妊娠12周包蜕膜和真蜕膜相贴近，子宫腔消失；③真蜕膜（壁蜕膜），指底蜕膜及包蜕膜以外覆盖子宫腔的蜕膜（C对AB错）；囊胚着床后，其外层为滋养层，增殖分化为原始绒毛，与底蜕膜相接触的发育成叶状绒毛膜，与包蜕膜接触的退化为滑泽绒毛膜（DE错）。